主动转运的主要特点是
A. 逆浓度梯度
B. 有饱和性
C. 有竞争性抑制现象
D. 有选择性
E. 以上都是

正确答案：E。以上都是